男，70岁。因咳嗽、咳痰30年，气短5年，近期加重前来体检。胸部X线片显示双肺透光度增加。其胸部查体最可能出现的体征是
A. 叩诊过清音
B. 呼吸音增强
C. 叩诊实音
D. 语颤增强
E. 三凹征

正确答案：A。叩诊过清音

解析：患者为老年男性，咳嗽、咳痰、气短（为慢阻肺的典型症状），近期体检X线显示双肺透光度增加，说明患者为慢性阻塞性肺气肿，触诊双侧语颤减弱（D错），叩诊肺部过清音（A对C错），心浊音界缩小，肺下界和肝浊音界下降，听诊双肺呼吸音减弱（B错），呼气期延长，部分患者可闻及湿性啰音和（或）干性啰音。三凹征（E错）是指吸气时胸骨上窝、锁骨上窝、肋间隙出现明显凹陷，是由于上部气道部分梗阻所致吸气性呼吸困难，常见于气管异物、喉水肿、白喉等。